霍乱传播途径中作用最突出的是
A. 苍蝇
B. 鼠
C. 水
D. 蚊子
E. 恙螨

正确答案：C。水

解析：霍乱传播途径中作用最突出的是水（C对），霍乱弧菌能通过污染鱼、虾等水产品引起传播。生活接触及苍蝇（A错），也可引起传播，但不是最主要的传播方式。以鼠（B错）为传播媒介的传染病为鼠疫、流行性出血热等。以蚊子（D错）为传播媒介的传染病为乙型脑炎、疟疾等。以恙螨（E错）为传播媒介的传染病为野鼠型肾病综合征出血热。